男，35岁，已婚。因尿道口有脓性分泌物到医院就诊，被诊断为淋病。为防止该病传染给患者妻子，医师符合伦理的最佳做法是
A. 请示当地疾病预防控制中心
B. 劝说患者告知其妻子实情
C. 将实情直接告知其妻子
D. 告知患者所在单位
E. 同意不告知患者妻子

正确答案：B。劝说患者告知其妻子实情

解析：医生应当自主做出解决问题的最佳决策，与患者沟通并达到一致，而非请示当地疾病预防控制中心（A错）。医生劝说患者告知其妻子实情，既维护了患者的隐私权、保障了患者的自主权，又不使患者做出错误决定危及他人和社会健康（B对）。若医生将实情直接告知其妻子或告知患者所在单位，明显的侵犯了患者的隐私权（CD错）。当病人和家属错误地行使自主权，所做的决定明显危害病人、他人的健康和生命或社会安全时，医院是一方都有权加以抵制、纠正，即可行使干涉权。医生同意不告知患者妻子，会明显危害病人妻子的健康（E错）。